不符合《精神卫生法》规定条件的医疗机构擅自从事精神障碍诊断、治疗的，由县级以上人民政府卫生行政部门责令停止相关诊疗活动，给予警告，并处（）罚款，有违法所得的，没收违法所得。
A. 2000～3000
B. 3000～5000
C. 5000～10000
D. 10000～20000
E. 20000以上

正确答案：C。5000～10000